动物由低等向高等发展过程中，牙齿的演化叙述正确的是
A. 牙数目由少变多
B. 牙形由复杂异形变为单一同形
C. 牙替换次数由双牙列变为多牙列
D. 牙附着于颌骨的方式由端生牙变为侧生牙最后演化槽生牙
E. 牙附着于颌骨的方式由侧生牙变为端生牙最后演化槽生牙

正确答案：D。牙附着于颌骨的方式由端生牙变为侧生牙最后演化槽生牙

解析：牙演化的特点：①牙形由单一同形牙向复杂异形牙演化；②牙数目由多变少；③牙的替换次数由多牙列向双牙列演化；④牙的分布由广泛至逐渐集中于上、下颌骨；⑤牙根从无到有，牙附着于颌骨的方式由端生牙至侧生牙，最后向槽生牙演化。掌握“牙的演化”知识点。